蛇床子的功效是
A. 健脾止泻
B. 燥湿祛风
C. 杀虫止痒
D. 温肾壮阳
E. 坠痰镇惊

正确答案：B、C、D。燥湿祛风；杀虫止痒；温肾壮阳

解析：本题考查的是蛇床子的功效。蛇床子的功效是燥湿祛风（B对）、杀虫止痒（C对）与温肾壮阳（D对）。蛇床子：【功效】燥湿祛风，杀虫止痒，温肾壮阳。薏苡仁：【功效】利水渗湿，健脾止泻（A错），除痹，清热排脓。铅丹：【功效】外用拔毒止痒，敛疮生肌；内服坠痰镇惊（E错），攻毒截疟。